一个大型城市进行区域性污染监测时，采样点的设置为
A. 四周布点
B. 扇形布点
C. 烟波下方布点
D. 几何状布点
E. 梅花布点

正确答案：D。几何状布点

解析：本题考查采样点的设置。一个大型城市进行区域性污染监测时，采样点的设置为几何状布点（D对ABCE错）。